属于水溶性高分子增稠材料的是
A. 羟苯乙酯
B. 明胶
C. 乙烯-醋酸乙烯共聚物
D. β-环糊精
E. 醋酸纤维素肽酸酯

正确答案：B。明胶

解析：本题考查水溶性高分子增稠材料。明胶（B对）是一种增稠剂。增稠剂是指一类水溶性高分子材料，溶于水后，其溶液黏度随浓度的增大而增大，可以减慢药物扩散速度，延缓其吸收，主要用于液体制剂。属于水溶性高分子增稠材料除明胶外还有：PVP、CMC、PVA、右旋糖酐等。羟苯乙酯（A错）是液体制剂中常用的防腐剂。乙烯-醋酸乙烯共聚物（C错）为不溶性骨架材料。β-环糊精（D错）常用于包合物的制作。醋酸纤维素酞酸酯（CAP）（E错）为肠溶性包衣材料。